小儿先画直线后画圆圈、图形，遵循了生长发育的哪一项规律
A. 由上到下
B. 由近到远
C. 由粗到细
D. 由低级到高级
E. 由简单到复杂

正确答案：E。由简单到复杂

解析：小儿先画直线后画圆圈、图形，遵循了生长发育由简单到复杂的规律。掌握“小儿生长发育规律”知识点。